根据《中共中央国务院关于深化医药卫生体制改革的意见》，我国深化医药卫生体制改革的总体目标是
A. 建立健全覆盖城乡居民基本医疗卫生制度，为群众提供安全、有效、方便、价廉的医疗卫生服务
B. 建立覆盖城乡居民享有均等化的基本医疗卫生服务和基本医疗保障管理制度
C. 按照预防为主、安全有效、使用方便、中西药联用的原则，结合我国用药特点，建立健全药品供应保障体系
D. 发挥市场机制，建立营利性医疗机构为主体，非息营利性医疗机构为补充的覆盖城乡的医疗服务体系

正确答案：A。建立健全覆盖城乡居民基本医疗卫生制度，为群众提供安全、有效、方便、价廉的医疗卫生服务

解析：本题考查的是基本医疗卫生制度的建立。根据《中共中央国务院关于深化医药卫生体制改革的意见》，我国深化医药卫生体制改革的总体目标是建立健全覆盖城乡居民基本医疗卫生制度，为群众提供安全、有效、方便、价廉的医疗卫生服务（A对）。基本医疗卫生制度的建立：深化医药卫生体制改革是全面深化改革的重要内容，是维护人民群众健康福祉的重大民生工程、民心工程。2009年4月6日，《中共中央国务院关于深化医药卫生体制改革的意见》（中发〔2009〕6号）（以下简称“新医改意见”）发布，标志着我国医药卫生体制进入深化改革新阶段。新医改意见坚持把基本医疗卫生制度作为公共产品向全民提供的核心理念，坚持保基本、强基层、建机制的基本原则，首次明确了深化医药卫生体制改革总体目标是建立健全覆盖城乡居民的基本医疗卫生制度，为群众提供安全、有效、方便、价廉的医疗卫生服务。即建设覆盖城乡居民的公共卫生服务体系、医疗服务体系、医疗保障体系、药品供应保障体系，形成四位一体的基本医疗卫生制度。四大体系相辅相成，配套建设，协调发展。同时，完善保障医药卫生体系有效规范运转的体制机制，完善医药卫生的管理、运行、投入、价格、监管体制机制，建立协调统一的医药卫生管理体制、高效规范的医药卫生机构运行机制、政府主导的多元卫生投入机制、科学合理的医药价格形成机制、严格有效的医药卫生监管体制、可持续发展的医药卫生科技创新机制和人才保障机制、实用共享的医药卫生信息系统、医药卫生法律制度，保障医药卫生体系有效规范运转。